流行病学实验中实验对象分组应是
A. 根据实验者需要随意将实验对象分为实验组及对照组
B. 根据被实验者意愿，分为实验组及对照组
C. 实验对象被分为实验组及对照组的概率相等
D. 实验对象被分为实验组的概率应大于分为对照组的概率

正确答案：C。实验对象被分为实验组及对照组的概率相等

解析：本题考查实验流行病学实验对象的分组。在实验流行病学中，研究对象通过随机分配形成实验组和对照组，从而保证实验开始时，两组在有关各方面相当近似或可比，即实验对象被分为实验组及对照组的概率是相等的（C对ABD错）。